某男，49岁。症见大便脓血、里急后重、发热腹痛。医师处以香连丸，处方组成：萸黄连800g、木香200g。以上二味，粉碎成细粉，过筛，混匀，每100g粉末用米醋8g，加适量的水泛丸，干燥，即得。关于处方中萸黄连的炮制方法和作用的说法，错误的是
A. 炮制萸黄连时，每100kg黄连片，用吴茱萸10kg
B. 萸黄连是吴茱萸和黄连片共同拌炒而得
C. 吴茱萸性热，可抑制黄连的寒性
D. 萸黄连擅清气分湿热，散肝胆郁火
E. 黄连经吴茱萸炮制后，可提高小檗碱的溶出率

正确答案：B。萸黄连是吴茱萸和黄连片共同拌炒而得

解析：本题考查的是黄连的炮制方法和炮制作用。处方中萸黄连的炮制方法和作用的说法，错误的是萸黄连是吴茱萸和黄连片共同拌炒而得（B错，为本题正确答案）。黄连【炮制方法】处方用名有黄连、川连、酒黄连、姜黄连、吴萸连、萸黄连。萸黄连：取吴茱萸加适量水煎煮，取汁去渣，煎液与黄连片拌匀，稍闷润，待药液被吸尽后，置炒制容器内，用文火加热，炒干，取出晾凉，筛去碎屑。每100kg黄连片，用吴茱萸10kg（A对）。【炮制作用】黄连味苦，性寒。归心、肝、胃、大肠经。具有泻火解毒、清热燥湿的作用，用于湿热痞满，呕吐，泻痢，黄疸，高热神昏，心火亢盛，心烦不寐，血热吐衄，目赤吞酸，牙痛，消渴，痈肿疔疮；外治湿疹，湿疮，耳道流脓。吴茱萸制黄连抑制其苦寒之性（C对），使黄连寒而不滞，以清气分湿热，散肝胆郁火为主（D对）。黄连中含有小檗碱、黄连碱、掌叶防己碱、药根碱、甲基黄连碱、木兰花碱等。黄连经酒、姜汁、吴茱萸汁炮制后，主要化学成分无明显变化，但可提高小檗碱在水中的溶出率（E对）。